男，45岁，体检发现血压150/96mmHg，心率80次/分，血糖8.0mmol/L，HbALC8.0%，血蛋白酶500umol/L，选择ACEI类药物的主要原因
A. 降低心率
B. 改善胰岛素抵抗
C. 促进尿酸排泄
D. 降低外周血管阻力
E. 肾脏保护

正确答案：B。改善胰岛素抵抗

解析：患者中年男性，血压150/96mmHg（正常值90～139/60～89mmHg，提示为高血压1级），血糖8.0mmol/L，HbALC8.0%，提示患者有糖尿病。因此患者可诊断为糖尿病伴高血压。对于高血压合并糖尿病的患者首选降压药是血管紧张素转化酶抑制剂（ACEI）。依那普利属于ACEI类降压药，其可抑制交感-肾素-血管紧张素-醛固酮系统，扩张外周血管而降低血压；还可改善胰岛素抵抗（B对）、减少尿蛋白形成，因此特别适合于高血压合并糖尿病的患者。β受体拮抗剂可通过抑制中枢和周围RAAS，抑制心肌收缩力和降低心率（A错）发挥降压作用。利尿剂（P253）降压作用主要通过排钠，减少细胞外容量，降低外周血管阻力（D错），其还可促进尿酸吸收，而不是排泄（C错）。依那普利可减少尿蛋白而起到肾脏保护（E错）的作用，但并不是本例选择依那普利的主要原因。